预防接种的免疫学效果评价指标是
A. 二代发病率
B. 感染率
C. 抗体阳转率
D. 疫苗保护率
E. 相对危险度

正确答案：C。抗体阳转率